苯丙酮尿症患儿最突出的临床表现是
A. 惊厥
B. 肌张力增高
C. 智能发育落后
D. 毛发、皮肤色泽变浅
E. 尿和汗液有鼠尿臭味

正确答案：C。智能发育落后